男，40岁。患慢性再生障碍性贫血2年，头晕、心悸加重10天。2个月前在输血过程中出现体温升高，达39.5℃，经对症处理后缓解。此次入院时化验血Hb50g/L。需给予输血治疗，应首选的血液成分是
A. 悬浮红细胞
B. 冰冻红细胞
C. 浓缩红细胞
D. 去白细胞的红细胞
E. 洗涤红细胞

正确答案：D。去白细胞的红细胞

解析：患者之前在输血过程中出现体温升高，达39.5℃，经对症处理后缓解，考虑为发热反应。原因可能是免疫反应，体内含有抗体。患者需要长期反复输血，因此此次输血首选去白细胞的红细胞（D对）。如发生输血过敏反应时，首选输入洗涤红细胞（E错）。